以药流浸膏为原料制备酊剂应采用
A. 稀释法
B. 渗漉法
C. 浸渍法
D. 煎煮法
E. 水蒸气蒸馏法

正确答案：A。稀释法

解析：本题考查的是酊剂的制备方法。以药流浸膏为原料制备酊剂应采用稀释法（A对）。酊剂系指原料药物用规定浓度的乙醇提取或溶解而制成的澄清液体制剂，也可用流浸膏稀释制成。酊剂可用溶解、稀释、浸渍或渗漉等方法制备。渗漉法（B错）：是不断向粉碎的中药材中添加新鲜浸出溶剂，使其渗过药材，从渗漉筒下端出口流出浸出液的一种方法。但该法消耗溶剂量大、费时长，操作比较麻烦。浸渍法（C错）：是在常温或温热（60℃～80℃）条件下用适当的溶剂浸渍药材以溶出其中有效成分的方法。本法适用于有效成分遇热不稳定的或含大量淀粉、树胶、果胶、黏液质的中药的提取。但本法出膏率低，需要特别注意的是当水为溶剂时，其提取液易于发霉变质，需注意加入适当的防腐剂。煎煮法（D错）：是中药材加入水浸泡后加热煮沸，将有效成分提取出来的方法。此法简便，但含挥发性成分或有效成分遇热易分解的中药材不宜用此法。水蒸气蒸馏法（E错）：适用于具有挥发性的、能随水蒸气蒸馏而不被破坏，且难溶或不溶于水的化学成分的提取。此类化合物的沸点多在100℃以上，并在100℃左右有一定的蒸气压。